妇女保健与儿童发展的关系是
A. 密切相关
B. 两个不同的发展时期
C. 无关
D. 有待研究
E. 可能有关

正确答案：A。密切相关

解析：本题考查妇女保健工作的重要性。女童期虽然尚不具有生殖功能，但其发育与发展，和妇女保健工作有密切相关的联系（A对BCDE错）。